对能够反应总人群某种基本流行状况的有代表性的人群进行检测，这属于
A. 常规报告
B. 被动检测
C. 哨点监测
D. 医院为基础的监测
E. 主动监测

正确答案：C。哨点监测

解析：哨点监测（C对）根据疾病流行特点对能够反应总人群某种基本流行状况的有代表性的人群进行检测，是主动监测（E错）的一种。由法定报告人上报传染病病例属于常规报告（A错），是被动监测（B错）的一种。在检测过程中，下级单位按照常规上报监测资料，而上级检测单位被动接受，称为被动监测（B错）：上级监测单位专门组织调查或者要求下级检测单位严格按照规定收集资料，称为主动监测（E错）。医院为基础的监测（D错）是以医院为现场进行监测。